办事见异思迁，虎头蛇尾的人，其意志活动缺乏
A. 自觉性
B. 果断性
C. 坚韧性
D. 自制性
E. 独立性

正确答案：C。坚韧性